甲状腺瘤的中医病名是
A. 气瘿
B. 血瘿
C. 石瘿
D. 筋瘿
E. 肉瘿

正确答案：E。肉瘿

解析：甲状腺瘤的临床特点是颈前无痛性肿块，多为单发，质地柔韧，光滑，边界清楚，随吞咽动作上下移动，生长缓慢，属于中医“肉瘿”的范畴（E对）。气瘿相当于西医学的单纯性甲状腺肿（A错），石瘿相当于西医学的甲状腺癌（C错）。